属于心理治疗原则的是
A. 真诚原则
B. 保密原则
C. “中立”原则
D. 回避原则
E. 以上四项都是

正确答案：E。以上四项都是

解析：心理治疗的原则：①真诚原则；②保密原则；③“中立”原则；④回避原则。掌握“心理治疗原则、主要方法及应用”知识点。